后牙颊舌侧卡环臂的固位力应相等，主要是为
A. 加强固位作用
B. 加强环抱作用
C. 防止义齿翘动
D. 防止义齿摆动
E. 防止义齿损伤

正确答案：D。防止义齿摆动

解析：本题考查可摘局部义齿的稳定。卡环的卡环臂尖位于倒凹区，是卡环产生固位作用的主要部分，卡环臂起始部分较坚硬，放置在非倒凹区，起稳定作用。后牙颊舌侧卡环臂的固位力相等主要是为了防止义齿的摆动（D对），因为颊舌侧的力相等可使基牙在颊舌向受力达平衡。加强环抱作用（B错）与基牙倒凹的深度以及是否产生制锁作用有关，与颊舌向固位力是否相等无关。而固位（A错）是针对义齿在行驶功能过程中是否向牙合向或就位道反方向脱位而言。翘动（C错）则是游离端义齿受食物粘着力、上颌义齿重力等作用，游离端基托向牙合向转动脱位，二者都与颊舌向固位力是否相等无关。后牙颊舌侧卡环臂的固位力相等在一定程度上也可防止基牙的损伤，但主要作用是防止义齿的摆动（E错）。